腭前神经阻滞麻醉时注射麻药过多、偏后可引起
A. 麻醉腭中神经
B. 麻醉腭后神经
C. 引起软腭麻痹而致恶心或呕吐
D. 引起悬雍垂麻痹致恶心或呕吐
E. 以上均对

正确答案：E。以上均对

解析：注意行腭大孔注射时，注射麻药不可过多，注射点不可偏后，以免同时麻醉腭中、腭后神经，引起软腭、悬雍垂麻痹而致恶心或呕吐。掌握“颌面部常用局麻法及牙拔除的麻醉选择”知识点。